属于影响健康教育效果评价的历史性因素是
A. 新的卫生政策颁布
B. 测试者的暗示效应
C. 调查人员工作经验增加
D. 因搬迁不能对居民进行随访
E. 测试对象的霍桑效应

正确答案：A。新的卫生政策颁布